足月儿生后2天出现黄疸，母亲血型为B型，胎儿O型，3天血清胆红素188.1μmol/L（11mg/dl）。本例诊断最大可能是
A. ABO溶血病
B. Rh溶血病
C. 生理性黄疸
D. 败血症
E. 胆道闭锁

正确答案：C。生理性黄疸